传染性单核细胞增多症血象的突出变化是
A. 白细胞正常伴异型淋巴细胞
B. 淋巴细胞增多伴异型淋巴细胞
C. 粒细胞增多伴异型淋巴细胞
D. 单核细胞增多伴异型淋巴细胞
E. 血小板增多伴异型淋巴细胞

正确答案：B。淋巴细胞增多伴异型淋巴细胞

解析：外周血象改变是传染性单核细胞增多症的重要特征，其淋巴细胞增多伴异型淋巴细胞（B对）具有诊断意义。早期白细胞总数可正常，粒细胞可增多。部分患儿的血小板计数可减少，但都不是本病的突出变化（ACDE错）。